姚某，男，2岁7个月，家长发现患儿上前牙“发黑”，要求治疗，检查左右上Ⅰ近中邻面浅龋。治疗一般采用
A. 药物治疗
B. 充填治疗
C. 修复治疗
D. 根管治疗
E. 观察随诊

正确答案：A。药物治疗

解析：本题考查龋病的治疗。姚某，男，2岁7个月，家长发现患儿上前牙“发黑”，要求治疗，检查左右上1近中邻面浅龋。治疗一般采用药物治疗（A对）。龋病药物治疗的适应证：（1）恒牙早期釉质龋，尚未形成龋洞者，特别是位于易清洁的平滑面病损（符合题干）。（2）乳前牙邻面浅龋及乳磨牙面广泛性浅龋，1年内将被恒牙替换者。（3）静止龋，如面点隙龋损，由于面磨耗，将点隙磨掉，成一浅碟状，使致龋环境消失。由于患儿年幼，并且左右上1为浅龋，故不用充填治疗（B错），一般采用防龋药物局部涂擦的方式进行治疗，并对患儿家长进行龋病的预防性教育。修复治疗适用于患牙缺损较大，充填治疗无法获得足够固位者，该患牙为浅龋，故无需进行修复治疗（C错）。浅龋未涉及牙髓，不用根管治疗（D错）。该患儿已出现龋坏，只观察随诊而不采取其他措施，龋病将会继续发展，不宜采用（E错）。